缓冲作用最快的是
A. 肾脏
B. 肺脏
C. 血液的缓冲
D. 组织细胞
E. 血液的缓冲系统

正确答案：E。血液的缓冲系统

解析：缓冲作用最快的是血液的缓冲（E对）。一旦有酸性或碱性物质入血，缓冲物质就立即与其反应，将强酸或强碱中和转变成弱酸或弱碱，同时缓冲系统自身被消耗，故缓冲作用不易持久.